关于吸入性窒息急救错误的是
A. 应立即行气管切开术
B. 悬吊下坠的上颌骨骨块
C. 充分吸出进入下呼吸道的分泌物及其他异物
D. 注意防治肺部并发症
E. 充分吸出进入下呼吸道的血液

正确答案：B。悬吊下坠的上颌骨骨块

解析：本题考查吸入性窒息。关于吸入性窒息急救错误的是悬吊下坠的上颌骨骨块（B错，为本题正确答案）。悬吊下坠的上颌骨骨块属于阻塞性窒息。吸入性窒息的急救：应立即行气管切开术（A对），通过气管导管，充分吸出进入下呼吸道的血液（E对）、分泌物及其他异物（C对），解除窒息。此类患者要特别注意防治肺部并发症（D对）。